有五个不同职业人群的冠心病患病率资料，若比较职业不同患病率是否相同。比较不同职业人群的冠心病患病率的假设检验，应计算的统计量为
A. t
B. χ²
C. F
D. χ
E. p

正确答案：B。χ²

解析：有五个不同职业人群的冠心病患病率资料，若比较职业不同患病率是否相同，即为多个样本率的比较，应选用R×C列联表资料的χ²检验（B对）。t（A错）检验是用于计量资料两组均数比较的检验方法。F（C错）检验是由两样本方差推断两总体方差是否相同的检验方法。